引起细菌性痢疾的是
A. 脑膜奈瑟菌
B. 福氏志贺菌
C. 白假丝酵母菌
D. 幽门螺旋杆菌
E. 变异链球菌

正确答案：B。福氏志贺菌

解析：本题考查肠杆菌属。引起细菌性痢疾的是福氏志贺菌（B对）。脑膜奈瑟菌（A错）即脑膜炎球菌感染会引发流行性脑脊髓膜炎。白色假丝酵母菌（C错）又称白色念珠菌，是一种真菌，通常存在于正常人口腔，上呼吸道，肠道及阴道，一般在正常机体中数量少，不引起疾病，当机体免疫功能或一般防御力下降或正常菌群相互制约作用失调，则本菌大量繁殖并改变生长形式（芽生菌丝相）侵入细胞引起疾病。幽门螺旋杆菌（D错）感染引起慢性胃炎或胃溃疡。变异链球菌（E错）是龋齿的病原菌。